下列表现中属于阴证的是
A. 皮肤红活焮赤
B. 肿胀范围局限
C. 皮色紫暗
D. 肿势高突
E. 以上均非

正确答案：C。皮色紫暗

解析：皮肤颜色紫暗或皮色不变的属阴（C对）。皮肤颜色红活焮赤（A错）的属阳。肿胀范围局限（B错）、根脚收束的属阳。肿势高起（D错）的属阳。